下列哪项是肺气肿患者心浊音界改变的特点
A. 心浊音界不变
B. 心浊音界向左下扩大
C. 心浊音界向右扩大
D. 心浊音界缩小
E. 心浊音界向左右两侧扩大

正确答案：D。心浊音界缩小

解析：肺气肿患者心浊音界改变的特点是缩小（D对）或叩不清。心浊音界不变（A错）是大多数正常人的临床表现。心浊音界向左下扩大（B错）可见于右侧大量胸腔积液。心浊音界向右扩大（C错）可见于左侧气胸。心包积液主要由肿瘤、特发性心包炎和肾衰竭造成，其浊音界改变情况为心浊音界向两侧扩大（E错）。